肝能调畅情志，其理论依据是
A. 疏通气机
B. 调节血量
C. 贮藏血液
D. 疏泄胆汁
E. 调节脾胃升降

正确答案：A。疏通气机

解析：本题考查的是肝的生理功能。肝能调畅情志，其理论依据是疏通气机（A对）。肝的生理功能，调畅情志：情志活动以气机调畅、气血调和为重要条件。“肝喜条达而恶抑郁”为其生理特性。肝的疏泄功能正常，气机调畅，气血平和，则心情舒畅，情志活动才能正常。肝的疏泄功能障碍，气机失于调畅，则会导致精神情志活动的异常，例如，易于抑郁、善怒等。促进胆汁生成与排泄（D错）：胆汁由肝之余气而生，汇聚胆囊，在肝的疏泄作用下，排泄至小肠，以助消化。若肝气郁结，疏泄失职，胆汁的分泌排泄障碍，不仅会影响消化吸收功能，致厌油腻、腹胀；而且会导致胆汁郁积，进而形成结石，见胁痛、黄疸等症。协调脾胃升降（E错）：肝调畅气机，协调脾之升清与胃之降浊，维持正常的消化吸收功能。肝藏血，是指肝具有贮藏血液、调节血量和防止出血的功能。（1）贮藏血液（C错）：肝为血海，能贮存一定的血量，以制约肝的阳气升腾，勿使过亢，以维护肝的疏泄功能，使之冲和条达。（2）调节血量（B错）：肝调节人体各部分的血量分配，特别是对外周血量的调节起着主要的作用。当机体活动剧烈或情绪激动时，肝就把所贮存的血液向机体的外周输布，以供应机体活动的需要；在人体安静、休息或情绪稳定时，机体外周血液需要量相对减少，则部分血液回流于肝而藏之。